我国狂犬病的主要传染源是
A. 患者
B. 病犬
C. 家猫
D. 野狼
E. 吸血蝙蝠

正确答案：B。病犬

解析：狂犬病的传染源是带狂犬病毒的动物。在我国，狂犬病的主要传染源是病犬（B对）。狂犬患者（A错）唾液中所含病毒量少，不形成人与人之间的传染，不是传染源。其次为猫（C错）、猪、牛、马等家畜；在发达国家，狂犬病的主要传染源是吸血蝙蝠（E错）、野狼（D错）、狐狸、浣熊等野生动物。